现代健康观及其内涵的拓展不包括
A. 从个体到群体
B. 从单维到多维
C. 从消极到积极
D. 从个体健康到家庭、组织、社区、城市、国家和全球健康
E. 从单纯的疾病管理到对不同生命状态的健康管理

正确答案：E。从单纯的疾病管理到对不同生命状态的健康管理

解析：本题考查现代健康观内涵的发展过程。现代健康观及其内涵经历了从个体到群体（A对），从单维到多维（B对）、从消极到积极（C对）、从个体健康到家庭、组织、社区、城市、国家和全球健康（D对）等多方面的拓展。现代健康观内涵的发展过程不包括从单纯的疾病管理到对不同生命状态的健康管理（E错，为本题正确答案）。